由于结核性胸膜炎的胸水蛋白含量高，容易引起胸膜粘连，为防止粘连应采取下列哪项措施
A. 原则上应尽早尽快反复抽除
B. 每周4次
C. 不论有多少胸水都要立刻完全抽除
D. 无呼吸困难症症状可不抽除
E. 每周1次

正确答案：A。原则上应尽早尽快反复抽除

解析：由于结核性胸膜炎的胸水蛋白含量高，容易引起胸膜粘连，为防止粘连应采取尽早尽快反复抽除抽尽胸腔内积液（A对BE错）。不论有多少胸水都要立刻完全抽除（C错）可使胸腔压力骤降，发生复张后肺水肿或循环衰竭。无呼吸困难症症状可不抽除一般见于类肺炎性胸腔积液（D错）。